高温堆肥的卫生标准中，就以下几项提出了要求，除了
A. 堆温
B. 粪大肠菌值
C. 蛔虫死亡率
D. 苍蝇
E. 腐殖质含量

正确答案：E。腐殖质含量

解析：本题考查高温堆肥的卫生标准。高温堆肥是一种有效的堆肥方式，它可以有效地提高堆肥的质量，从而提高土壤的肥力。高温堆肥的卫生标准是指在高温堆肥过程中，要求堆肥的温度（A对）、粪大肠菌值（B对）、蛔虫死亡率（C对）、苍蝇（D对）等指标必须达到一定的标准，以保证堆肥的卫生质量。腐殖质含量（E错，为本题正确答案）是指腐殖质在土壤中的含量，卫生标准没有对其提出要求。